口服虽易吸收，但对胃有强烈的刺激性
A. 地西泮
B. 苯巴比妥
C. 西地兰
D. 三唑仑
E. 水合氯醛

正确答案：E。水合氯醛